属于5-羟色胺与去甲肾上腺素再摄取抑制剂的抗抑郁药物是
A. 吗氯贝胺
B. 艾司西酞普兰
C. 文拉法辛
D. 马普替林
E. 瑞波西汀

正确答案：C。文拉法辛

解析：本题考查抗抑郁药。属于5-羟色胺与去甲肾上腺素再摄取抑制剂的抗抑郁药物是文拉法辛（C对）。抗抑郁药根据化学结构及作用机制的不同可分为选择性5-羟色胺（5-HT）再摄取抑制剂、5-HT及去甲肾上腺素再摄取抑制剂、去甲肾上腺素能及特异性5-HT能抗抑郁药、三环类抗抑郁药、四环类抗抑郁药、单胺氧化酶抑制剂、选择性去甲肾上腺素能抑制剂及其他类。（1）选择性5-羟色胺（5-HT）再摄取抑制剂：代表药物有氟西汀、帕罗西汀、舍曲林、艾司西酞普兰（B错）等。（2）5-HT及去甲肾上腺素再摄取抑制剂：代表药物有文拉法辛、度洛西汀。（3）去甲肾上腺素能及特异性5-HT能抗抑郁药：米氮平。（4）三环类抗抑郁药：代表药物有阿米替林、丙咪嗪、氯米帕明和多塞平。（5）四环类抗抑郁药：代表药物为马普替林（D错）。（6）单胺氧化酶抑制剂：代表药物为吗氯贝胺（A错）。（7）其他：5-HT受体阻断剂/再摄取抑制剂曲唑酮；选择性去甲肾上腺素再摄取抑制剂瑞波西汀（E错）。